西德在1961年对反应停采取干预措施后，儿童先天畸形的发生率也下降，这符合病因判定标准中的
A. 时间顺序的证据
B. 关联强度的证据
C. 可重复性证据
D. 合理性证据
E. 终止效应的证据

正确答案：E。终止效应的证据